描述一组正态分布资料离散程度大小的最佳指标是
A. 四分位数间距
B. 标准差
C. 极差
D. 离均差平方和
E. 几何均数

正确答案：B。标准差

解析：描述一组正态分布资料集中程度大小的最佳指标是算数平均数；描述一组正态分布资料离散程度大小的最佳指标是标准差（B对）。描述一组偏态分布资料集中程度大小的最佳指标是中位数；描述一组偏态分布资料离散程度大小的最佳指标是四分位数间距（A错）。极差也称作全距，即观察值中最大值和最小值之差（C错），极差通常仅用于粗略地说明变量的波动范围。离均差平方和指的离散型随机变量的方差（D错）。几何均数用于反映一组经对数转换后呈对称分布的变量值在数量上的平均水平，在医学研究中常适用于免疫学的指标（E错）。